生产性有害因素作用于人体受一定因素的影响，其中起主要作用的是
A. 有害因素的强度（剂量）
B. 接触机会
C. 个体之间的差异
D. 有害因素种类
E. 以上都不是

正确答案：A。有害因素的强度（剂量）